治疗普通型流脑的首选抗生素是
A. 青霉素
B. 磺胺药
C. 氨苄西林
D. 红霉素
E. 庆大霉素

正确答案：A。青霉素

解析：青霉素（A对）对脑膜炎球菌有杀菌作用，注射大剂量能使脑脊液达到有效药物浓度而获得满意疗效；磺胺药（B错）从肾脏排除，可以在输尿管处沉淀形成结石引起血尿、尿痛，对肾脏病患者有损害；氨苄西林（C错）为半合成青霉素类，但可被格兰阴性菌产生的酶β～内酰胺酶破坏；红霉素（D错）对格兰阳性菌有抗菌作用，而脑膜炎球菌属格兰阴性菌；庆大霉素（E错）不易透过血脑屏障进入脑脊液，且具有肾毒性，会造成肾功能减退。